平原地区间日疟传播的主要媒介是
A. 淡色库蚊
B. 中华按蚊
C. 三带喙库蚊
D. 刺扰伊蚊
E. 微小按蚊

正确答案：B。中华按蚊